患者连续5年冬季无明显诱因出现咳嗽、咳痰，每年发病持续3个多月。查体：肺部X线显示两肺纹理增粗，呈条索状。其诊断是
A. 肺脓肿
B. 支气管哮喘
C. 肺结核
D. 支气管扩张
E. 慢性支气管炎

正确答案：E。慢性支气管炎

解析：慢性支气管炎的诊断要点为临床上以咳嗽、咳痰为主要症状或伴有喘息，每年发病持续3个月并连续两年或以上。除外具有咳嗽、咳痰、喘息症状的其他疾病，如支气管哮喘、支气管扩张、肺结核、尘肺、肺脓肿、心功能不全等。X线检查显示早期可无异常，随着病情发展，可见肺纹理增多、变粗、扭曲、呈网状或条索状阴影，向肺野周围延伸，以两肺中下野明显，据此可诊断为慢性支气管炎（E对）。肺脓肿（A错）的特点为咳吐大量腥臭脓痰。支气管哮喘（B错）表现为发作时伴有哮鸣音，呼吸困难。肺结核（C错）的特点为低热，消瘦，乏力，咳嗽，咳血。支气管扩张（D错）的特点为慢性咳嗽，咳大量脓痰，或反复咯血。